宫口开全后，开始保护会阴的时机应是
A. 经阴道外口看到胎发时
B. 胎头开始拨露时
C. 胎头拨露10分钟时
D. 胎头拨露阴唇后联合紧张时
E. 胎头开始着冠时

正确答案：D。胎头拨露阴唇后联合紧张时

解析：接产步骤：接产者站在产妇右侧，当胎头拨露使阴唇后联合紧张时，开始保护会阴（D对），当抬头枕部在耻骨弓下露出时，左手应按分娩机制协助胎头仰伸。此时若宫缩过强，应嘱产妇呼气消除腹压，并助产妇在宫缩间歇时稍向下屏气，使胎头缓慢娩出，以免过强的产力造成会阴撕裂。